某患者夜间突发急腹症被送到某医院看急诊，初诊为急性胆囊炎。负责医生因自己年轻，怕担风险，未作任何处理，即让家属把患者送到20里外的中心医院就诊，延误了治疗时间，致使病人胆囊穿孔、中毒性休克。后虽经抢救挽救了生命，但医药费用去2万多元。对该医生的正确伦理评价是
A. 没有什么问题，不想接诊的病人就可以让他转诊
B. 没有什么问题，风险太大时首先要保护好自己
C. 没有什么问题，当时情况可以转诊
D. 错误，违反首诊负责制要求，给患者造成严重伤害
E. 错误，没有把这件事报告给院长，擅自决定转诊

正确答案：D。错误，违反首诊负责制要求，给患者造成严重伤害